关于限定日剂量（DDD），下列说法错误的是
A. DDD通常用来评价药物的使用情况
B. DDD是指要达到治疗目的，用于成人的药物平均日剂量
C. 总DDD数(DDDs)是总用药量与该药 DDD的比值
D. 药物利用指数(DUl)是总DDD数与总用药天数的比值
E. 对于不同适应证，同一药物的DDD是相同的

正确答案：E。对于不同适应证，同一药物的DDD是相同的

解析：本题考查限定日剂量（DDD）的定义。DDD是指某一特定药物为治疗主要适应证而设立的用于成人的平均日剂量，作为标准的剂量单位应用时必须保证是特定药物、特定适应证、特指用于成人、特指平均日计量。因此，不同适应证，同一药物的DDD是不同的（E错，为本题正确答案）。用药人数(DDDs)＝药物的总用量/DDD值。